女性，28岁。婚后3天突起畏寒高热，尿频伴尿急，侧腰痛，既往无类似发作。尿常规：蛋白阴性，红细胞（0~3）个/HP，白细胞﹢﹢/HP。来急诊诊治，医生应如何处置
A. 等中段尿培养结果
B. 新诺明单剂量疗法
C. 氨苄青霉素静脉滴注
D. 诺氟沙星口服
E. 呋喃妥因口服

正确答案：C。氨苄青霉素静脉滴注